关于上颌窦癌的描述，错误的是
A. 肿瘤发生自上颌窦上壁时，可出现眼球突出和复视
B. 肿瘤发生自上颌窦外壁时，可表现为面部及唇颊沟肿胀
C. 肿瘤发生自上颌窦后壁时，可侵及蝶窦及翼板
D. 肿瘤发生自上颌窦下壁时，可侵入翼腭窝引起张口困难
E. 肿瘤发生自上颌窦内壁时，可出现鼻塞，出血

正确答案：D。肿瘤发生自上颌窦下壁时，可侵入翼腭窝引起张口困难

解析：本题考查上颌窦癌。关于上颌窦癌的描述，错误的是肿瘤发生自上颌窦下壁时，可侵入翼腭窝引起张口困难（D错，为本题的正确答案）。根据肿瘤发生的部位，临床上可出现不同的症状：肿瘤发生自上颌窦上壁时，可出现眼球突出、移位和复视（A对）；当肿瘤发生自上颌窦外壁时，可表现为面部及唇颊沟肿胀（B对）；发生自上颌窦后壁时，可侵入翼腭窝而引起张口困难，晚期可发展到蝶窦及翼板（C对）；当肿瘤发生自上颌窦下壁时，可引起牙松动、疼痛、龈颊沟肿胀；肿瘤发生自上颌窦内壁时，可出现鼻阻塞、鼻出血及流泪现象（E对）。